男性肝硬化患者性欲减退、睾丸萎缩、肝掌的原因是
A. 雄激素过多
B. 肾上腺皮质激素过多
C. 雌激素过多
D. 甲状腺激素过多
E. 醛固酮过多

正确答案：C。雌激素过多

解析：肝硬化患者可有激素代谢异常，如雌激素增多、雄激素减少（A错）、肾上腺皮质激素减少（B错）、抗利尿激素增多、甲状腺激素减少（D错）和醛固酮增多。雌激素由肝脏灭活，肝硬化时肝功能减退，雌激素增多，引起男性患者性欲减退、睾丸萎缩、肝掌（C对）。醛固酮（E错）也由肝脏灭活，肝硬化时醛固酮增多，钠重吸收增加，引起腹水。